甲状腺素临床用于
A. 治疗甲状腺功能亢进症
B. 治疗单纯性甲状腺肿
C. 治疗甲状腺危象
D. 甲状腺手术前准备
E. 甲状腺功能检查

正确答案：B。治疗单纯性甲状腺肿

解析：本题考查甲状腺素的临床应用。甲状腺激素主要用于甲状腺功能低下的替代治疗。1.呆小病；2.黏液性水肿；3.单纯性甲状腺肿（C对）；4.T₃抑制试验。治疗甲状腺功能亢进症（A错）、甲状腺手术前准备（D错）可用硫脲类抗甲状腺药。治疗甲状腺危象（C错）可用大剂量碘剂。甲状腺功能检查（E错）可用放射性碘。